深色蔬菜较浅色蔬菜富含
A. 碳水化合物
B. 胡萝卜素
C. 维生素B₁
D. 蛋白质
E. 纤维素

正确答案：B。胡萝卜素